含双酯基的抗胆碱药是
A. 溴新斯的明
B. 硝酸毛果芸香碱
C. 硫酸阿托品
D. 氯化琥珀胆碱
E. 丁溴东莨菪碱

正确答案：D。氯化琥珀胆碱